女，32岁。农村居住，甲亢6年，疏于治疗，长期不愈，临床疑诊甲亢合并心脏病，心功能Ⅱ级。甲状腺I°肿大，甲状腺¹³¹I摄取率3小时68%，24小时90%。下列哪项治疗应首先考虑
A. 甲巯咪唑治疗
B. 丙硫氧嘧啶治疗
C. 手术治疗
D. 甲疏咪唑+普萘洛尔治疗
E. ¹³¹I治疗

正确答案：E。¹³¹I治疗

解析：青年女性患者，农村居住（经济条件一般），甲亢6年，疏于治疗，长期不愈，临床疑诊甲亢合并心脏病（¹³¹I治疗治疗的适应症），心功能Ⅱ级，甲状腺I°肿大，甲状腺¹³¹I治疗摄取率3小时68%，24小时90%（131I摄取率正常值（盖革计数管测定）为3小时5%~25%，24小时20%~45%，高峰在24小时出现，提示甲状腺功能亢进），结合患者的症状、体征和实验室检查，考虑诊断为甲亢合并心脏病，故下列哪项治疗应首先考虑¹³¹I治疗（E对）。甲巯咪唑治疗（A错）、丙硫氧嘧啶治疗（B错）为药物治疗，一般适应于以下情况：①轻、中度病情；②甲状腺轻、中度肿大；③孕妇、高龄或由于其他严重疾病不适宜手术者；④手术前和¹³¹I治疗前的准备；⑤手术后复发且不适宜¹³¹I治疗者；⑥中至重度活动的G0病人。手术治疗（C错）一般适用于以下情况：①甲状腺肿大显著（>80g），有压迫症状；②中、重度甲亢，长期服药无效，或停药复发，或不能坚持服药者；③胸骨后甲状腺肿；④细针穿刺细胞学(FNAC）证实甲状腺癌或者怀疑恶变；⑤ATD治疗无效或者过敏的妊娠病人，手术需要在妊娠T2期（4~6个月）施行。普萘洛尔治疗（D错）一般用于甲状腺危象、甲状腺术前准备治疗。